某患者上呼吸道感染，用氨苄西林治疗一周，未见明显好转，后改用舒他西林，症状得到改善。关于舒他西林结构和临床使用的说法，错误的是
A. 为一种前体药物
B. 给药后，在体内非特定酯酶的作用下水解成氨苄西林和舒巴坦
C. 对β-内酰胺酶的稳定性强于氨苄西林
D. 抗菌效果优于氨苄西林，原因是它在体内生成的两种药物都有较强的抗菌活性
E. 可以口服，且口服后吸收迅速

正确答案：D。抗菌效果优于氨苄西林，原因是它在体内生成的两种药物都有较强的抗菌活性

解析：本题考查舒它西林结构和临床使用。舒它西林在体内代谢生成的舒巴坦，为人工合成的不可逆的竞争性β-内酰胺酶抑制剂，本身的抗菌活性很弱（D错，为本题正确答案）。舒它西林是前体药物（A对）。该化合物作为双前体药物，口服后可迅速吸收（E对），在吸收时发生水解，向体循环释放出等分子量的氨苄西林和舒巴坦（B对）而起联合的抗菌作用。舒它西林对β-内酰胺酶的稳定性强于氨苄西林（C对）。